属于精神药品的是
A. 阿片类
B. 镇静催眠药
C. 烟草
D. 水杨酸类
E. 酒精

正确答案：B。镇静催眠药

解析：精神药品是指对中枢神经系统具有抑制作用的镇静催眠药或具有兴奋作用的中枢兴奋药物。镇静催眠药是一类对中枢神经系统具有抑制作用的药物（B对）。